毒作用敏感性形成的原因主要是
A. 代谢酶的遗传多态性
B. 修复能力差异
C. 受体因素
D. 宿主的其他因素
E. 以上都是

正确答案：E。以上都是